患者，男，70岁。患糖尿病2年，不规则服用降糖药。突发昏迷6小时。血压90/60mmHg，心率30次/分，律齐。血钠160mmol/L，血糖34mmol/L，尿酮体（-），动脉血pH7.3。应首先考虑的治疗药物是
A. 静脉滴入碳酸氢钠
B. 静脉滴入低渗盐水
C. 小剂量胰岛素与低渗盐水静脉滴人
D. 大剂量胰岛素与低渗盐水静脉滴人
E. 小剂量胰岛素与等渗盐水静脉滴注

正确答案：E。小剂量胰岛素与等渗盐水静脉滴注

解析：高渗性非酮症糖尿病昏迷临床可见血糖＞33.3mm0l/L，血钠＞155mmol/L，血浆渗透压显著升高，但无酮症或较轻，故诊断为高滲性非酮症昏迷，治疗应该以小剂量胰岛素与等渗盐水静脉滴注（E对ABCD错）。